第四脑室借正中孔和左、右外侧孔与相通
A. 脊髓中央管
B. 第三脑室
C. 硬膜下腔
D. 蛛网膜下腔
E. 硬膜外隙

正确答案：D。蛛网膜下腔

解析：单一的第四脑室正中孔,位于菱形窝下角的正上方。成对的第四脑室外侧孔,位于第四脑室外侧隐窝的尖端，第四脑室借正中孔和左、右外侧孔与蛛网膜下隙（D对）相通。